关于疾病监测的描述，不正确的是
A. 疾病监测是长期、连续、系统的过程
B. 疾病监测观察疾病动态变化
C. 疾病监测不仅涉及疾病的发病和死亡情况，还收集其他相关资料
D. 疾病监测可用于评价干预效果
E. 疾病监测资料只要求上报，但反馈不属于疾病监测范畴

正确答案：E。疾病监测资料只要求上报，但反馈不属于疾病监测范畴